采用微粒化工艺之后，克服了原有口服剂型在肝脏内很快失活的缺点，能够用于治疗月经失调，先兆流产的药物是
A. 左炔诺孕酮
B. 地屈孕酮
C. 甲羟孕酮
D. 黄体酮
E. 羟孕酮

正确答案：D。黄体酮

解析：本题考查黄体酮的剂型及适应症。黄体酮口服后在肝脏内很快失活，故以往不能口服。经微粒化后的产品可以口服，用于月经失调，如闭经和功能失调性子宫出血、黄体功能不全、先兆流产和习惯性流产（D对）。